一般情况下，当POV超过（）时，表示油脂酸败
A. 0.20g/100g
B. 0.25g/100g
C. 0.30g/100g
D. 0.35g/100g
E. 0.40g/100g

正确答案：B。0.25g/100g